氰化物所具有的气味是
A. 苦杏仁味
B. 蒜味
C. 苯酚味
D. 酒味
E. 尿素味

正确答案：A。苦杏仁味

解析：氰化物轻度中毒为明显的头痛、头晕、胸闷、心悸、恶心、呕吐、乏力；重度中毒会出现昏迷，癫痫大发作样抽搐，严重代谢性酸中毒，猝死。氰化物一般为无色晶体，在空气中易潮解并有氰化氢的微弱臭味，能使水产生杏仁臭（A对BCDE错）。